临床上最常见的输血反应是
A. 非溶血性发热反应
B. 变态反应
C. 过敏反应
D. 溶血反应
E. 细菌污染反应

正确答案：A。非溶血性发热反应

解析：非溶血性发热反应是临床上最常见的输血反应，发生率约为2%-10%（A对）。变态反应（B错），即过敏反应（C错），多发生在输血数分钟后，也可在输血中或输血后发生，发生率约为3%。溶血反应（D错）是最严重的输血并发症，死亡率高，但很少发生。细菌污染反应（E错），后果严重，但发生率也不高。